我国现行的水质标准对牙齿来说适宜的水氟浓度应是
A. 0.5～1ppm
B. 1ppm
C. 1～1.5ppm
D. 1.5～2ppm
E. ＞2ppm

正确答案：A。0.5～1ppm

解析：本题考查我国现行水质的标准氟浓度。氟有防龋的作用，但含量过高可以引起氟牙症甚至是氟骨症。因此我国现行的水质标准氟浓度为0.5～1ppm（A对）。